根据《中华人民共和国药品管理法》，从事下列活动，无需取得行政许可的事项是
A. 开办药物研究机构
B. 开办药品零售企业
C. 开办药品批发企业
D. 开办药品生产企业
E. 设立医疗机构制剂室

正确答案：A。开办药物研究机构

解析：本题考查的是药品行政许可事项。根据《中华人民共和国药品管理法》，从事下列活动，无需取得行政许可的事项是开办药物研究机构（A对）。药品行政许可事项：根据《药品管理法》《药品管理法实施条例》《麻醉药品和精神药品管理条例》等法律、行政法规以及其他设定行政许可的相关法律依据，国家对药品注册、安全监管与稽查设定了一系列行政许可项目。如：药品上市许可，表现形式为颁发药品注册证书；药品生产许可，表现形式为颁发《药品生产许可证》（D错）和《医疗机构制剂许可证》（E错）；药品经营许可，表现形式为颁发《药品经营许可证》（BC错）；国务院行政法规确认了执业药师执业许可，表现形式为颁发《执业药师注册证》。